在延髓与动眼神经副核属于同一功能柱的核团是
A. 下泌涎核
B. 孤束核
C. 疑核
D. 副神经核
E. 舌下神经核

正确答案：A。下泌涎核

解析：在延髓与动眼神经副核属于同一功能柱的核团是下泌涎核（A对），均属于一般内脏运动住。孤束核（B错）上端可达脑桥下端，下端至延髓内侧丘系交叉平面，该核上部（味觉核）属于特殊内脏感觉柱，下部（心-呼吸核）属于一般内脏感觉柱。疑核（C错）、副神经核（D错）、舌下神经核（E错）均位于延髓，前二核属于特殊内脏运动柱，舌下神经核属于一般躯体运动柱。